下列药品中，属于非处方药的是
A. 硝苯地平缓释片
B. 环磷酰胺片
C. 茶碱控释片
D. 盐酸溴己新片
E. 氨苄西林注射剂

正确答案：A。硝苯地平缓释片